厥阴头痛，可选用的引经药是
A. 羌活、蔓荆子
B. 羌活、川芎
C. 葛根、白芷
D. 柴胡、川芎
E. 吴茱萸、藁本

正确答案：E。吴茱萸、藁本

解析：厥阴头痛的引经药是吴茱萸、藁本（E对），太阳头痛的引经药是羌活、蔓荆子（A错），太阳头痛的引经药是羌活、川芎（B错），阳明头痛的引经药是葛根、白芷（C错），少阳头痛的引经药是柴胡、川芎（D错）。